管理小腿内侧和足内侧缘皮肤的感觉
A. 股前皮神经
B. 腓肠神经
C. 隐神经
D. 腓浅神经
E. 腓深神经

正确答案：C。隐神经

解析：股神经发出皮支隐神经（C对），该分支伴随股动脉进入收肌管下行，出此管后在膝关节内侧继续下行，于缝匠肌下端的后方浅出至皮下，随后与大隐静脉伴行沿小腿内侧面下行至足内侧缘，沿途发出分支分布于髌下、小腿内侧面及足内侧缘的皮肤